关于淋病，以下哪项不对
A. 淋病的传播途径主要为性交经粘膜感染
B. 淋菌对柱状上皮和移行上皮有亲和力
C. 淋病是由革兰染色阴性的淋病奈氏菌引起的
D. 淋病属于性传播疾病
E. 宫颈分泌物涂片找至淋球菌，是诊断淋病的金标准

正确答案：E。宫颈分泌物涂片找至淋球菌，是诊断淋病的金标准